本条例所称实验活动包括以下内容，但除外
A. 实验室从事与病原微生物菌（毒）种，样本有关的研究
B. 实验室从事与病原微生物菌（毒）种，样本有关的教学
C. 实验室从事与病原微生物菌（毒）种，样本有关的检测
D. 实验室从事与病原微生物菌（毒）种，样本有关的诊断
E. 实验室从事与病原微生物菌（毒）种，样本有关的治疗

正确答案：E。实验室从事与病原微生物菌（毒）种，样本有关的治疗